反复发作右侧肢体无力，常在1小时内恢复，头颅CT正常
A. 脑出血
B. 脑梗塞
C. 蛛网膜下腔出血
D. 短暂性脑缺血
E. 脑肿瘤

正确答案：D。短暂性脑缺血

解析：反复发作右侧肢体无力，常在1小时内恢复，头颅CT正常，考虑短暂性脑缺血（D对）。短暂性脑缺血是由于局部脑或视网膜缺血引起的短暂性神经功能缺损，症状多在2小时内消失，不留影像学及体征异常，且容易反复发作。脑出血（A错）可有头痛、恶心、呕吐等表现，查体可有脑实质损害的体征，如偏瘫、偏身感觉障碍及偏盲等，头颅CT可见圆形或卵圆形均匀高密度灶（P188）。脑梗塞（B错）可有明显脑实质损害症状，如偏瘫、偏身感觉障碍及偏盲等，24小时后头颅CT可见低密度梗死灶（P184）。蛛网膜下腔出血（C错）可有剧烈头痛、恶心呕吐等颅高压表现，脑膜刺激征阳性，头颅CT可见脑沟脑池高密度出血征象（P193）。脑肿瘤（E错）分为良性肿瘤和恶性肿瘤，良性肿瘤生长缓慢，局限在脑内，可引起颅内高压的症状，头颅CT多表现为低密度灶；恶性肿瘤生长迅速，可发生转移，也可引起颅内高压症状，威胁生命，头颅CT可表现为多密度灶。